关于肾与志液体华窍关系的表述正确的有
A. 在志为恐
B. 在液为涎
C. 在体为骨
D. 在华为毛
E. 在窍为耳

正确答案：A、C、E。在志为恐；在体为骨；在窍为耳

解析：本题考查的是肾与志、液、体、华、窍的关系关于肾与志液体华窍关系的表述正确的有在志为恐（A对）、在体为骨（C对）与在窍为耳（E对）。肾与志、液、体、华、窍的关系：1.肾在志为恐；2.肾在液为唾；3.肾在体合骨，其华在发；4.肾在窍为耳及二阴。在液为涎（B错）的是脾。脾与志、液、体、华、窍的关系：1.脾在志为思；2.脾在液为涎；3.脾在体合肌肉，主四肢；4.脾在窍为口，其华在唇。在华为毛（D错）的是肺。肺与志、液、体、华、窍的关系：1.肺在志为忧（悲）；2.肺在液为涕；3.肺在体合皮，其华在毛；4.肺在窍为鼻，喉为肺之门户。